女，38岁。发热、皮疹、脱发和口腔溃疡6个月。查体：T39.0℃，面部有充血性红斑，双手近端指间关节压痛，轻度肿胀，双下肢凹陷性水肿。实验室检查：尿蛋白（+++），尿红细胞（+++），24小时尿蛋白3.8g，血Plt88×10⁹/L，ANA1：640，抗SSA抗体（+），抗双链DNA抗体（+），补体C3低下。最佳治疗方案是泼尼松1mg/（kg·d）联合
A. 布洛芬
B. 血浆置换
C. 环磷酰胺
D. 青霉素
E. 柳氯磺吡啶

正确答案：C。环磷酰胺

解析：患者青年女性（系统性红斑狼疮好发人群），有发热、皮疹、脱发和口腔溃疡，面部可见充血性红斑，双手近端指间关节压痛，轻度肿胀，双下肢凹陷性水肿，实验室检查：尿蛋白（+++），尿红细胞（+++），尿蛋白3.8g/d（提示有大量蛋白尿），血Plt88×10⁹/L（正常值100～300×10⁹/L，减少），ANA1：640（提示抗核抗体阳性），抗SSA抗体（+），抗双链DNA抗体（+），补体C3低下，综合患者的临床表现、查体和实验室检查，考虑诊断为系统性红斑狼疮。其中补体C3低下、尿蛋白（+++）、抗双链DNA抗体（+）、血小板减少等指标提示疾病处于活动期。此时最佳治疗方案是泼尼松1mg/（kg·d）联合环磷酰胺（CTX）（C对）。环磷酰胺有利于更好地控制SLE活动，保护重要脏器功能，减少复发，以及减少长期激素的需要量和副作用。目前SLE尚不能根治，经过合理治疗可以得到长期缓解，糖皮质激素联合免疫抑制剂依然是SLE的主要治疗策略，强调早期诊断、早期治疗和遵循个体化原则。布洛芬（A错）属于非甾体抗炎药，可以用于短期控制关节炎，属于轻症狼疮的治疗措施，但长期使用会影响胃肠道和肾脏，需谨慎。血浆置换（B错）用于病情危重或一线治疗困难的病例。柳氯磺吡啶（E错）为氨基水杨酸制剂，主要用于溃疡性结肠炎的诱导缓解及维持治疗，以及脊柱关节炎的相关治疗。